53岁男性，因腮腺生长肿块进行就诊，术中病理切片显示为腺样囊性癌，则对于此肿瘤的说法错误的是
A. 腺样囊性癌又称为圆柱瘤，生长缓慢，病期较长
B. 呈浸润性生长，浸润周围神经可以引起疼痛和神经麻痹
C. 肿瘤剖面为灰白色实性肿块，有包膜
D. 可分为筛状型、管状型和实性型三种组织类型
E. 实性型通常比其他类型容易复发和早期转移

正确答案：C。肿瘤剖面为灰白色实性肿块，有包膜

解析：本题考查腺样囊性癌。53岁男性，因腮腺生长肿块进行就诊，术中病理切片显示为腺样囊性癌，则对于此肿瘤的说法错误的是肿瘤剖面为灰白色实性肿块，有包膜（C错，为本题正确答案）。腺样囊性癌又称为圆柱瘤，生长缓慢，病期较长（A对）。此瘤呈浸润性生长。肿瘤浸润周围神经可引起疼痛和神经麻痹（B对）。肉眼见肿瘤呈圆形或结节状，平均直径约3cm。剖面为灰白色或浅褐色实性肿块，无包膜，光镜观察分为三种组织类型：①腺性（筛状）型、②管状型、③实性型（D对）。实性型通常比其他类型容易复发和早期转移（E对），预后差。